简单而有效地区别挥发油和脂肪油的性质是
A. 溶解性
B. 挥发性
C. 稳定性
D. 旋光性
E. 折光性

正确答案：B。挥发性